一次注射体积一般为1～2ml，不适于刺激性大的药物的是
A. 静脉滴注
B. 皮下注射
C. 肌内注射
D. 皮内注射
E. 脊椎腔注射

正确答案：B。皮下注射